对经饮食摄入生物、化学和物理因素所做的定性和定量评估的是
A. 危害识别
B. 危害特征描述
C. 暴露评估
D. 风险特征描述
E. 风险管理

正确答案：C。暴露评估

解析：本题考查暴露评估。暴露评估（C对ABDE错）是指对食用时可能摄入生物、化学、物理因素和其他来源的暴露所作的定性和（或）定量评估。